下列可以抑制传染病流行的情况是
A. 人群人口数增加
B. 人群易感性升高
C. 人群易感性降低
D. 人群免疫力降低
E. 易感人群迁入

正确答案：C。人群易感性降低

解析：本题考查抑制传染病的流行。人群作为一个整体对传染病的易感程度称为人群易感性，人群易感性降低（C对ABDE错）对传染病的易感程度也就相对低，传染病就不易于在人群中发生和传播。